患儿出生后出现黄疸，考虑该患儿为ABO溶血，患儿血型为A型血，母亲血型为O型血，若进行换血治疗，应该选择
A. O型全血
B. O型血细胞和AB型血浆
C. O型血浆和AB型血细胞
D. 与新生儿相同的ABO血型
E. 与新生儿相同的血细胞，与母亲血型相同的血浆

正确答案：B。O型血细胞和AB型血浆

解析：换血疗法的主要目的是换出部分血中游离抗体和致敏红细胞，减轻溶血，母O型、子A或B型的ABO溶血病，最好用AB型血浆和O型血红细胞的混合血（B对），也可用抗A或抗B效价不高的O型血或患儿同型血；有明显贫血和心力衰竭者，可用血浆减半的浓缩血。